治疗行痹，应首选
A. 宣痹汤
B. 白虎加桂枝汤
C. 乌头汤
D. 薏苡仁汤
E. 防风汤

正确答案：E。防风汤

解析：行痹为风邪兼夹寒湿，留滞经脉，闭阻气血所致，治宜祛风通络，散寒除湿，方用防风汤（E对）。宣痹汤适用于风湿热痹，关节疼痛明显者（A错）。白虎加桂枝汤适用于风湿热痹，热象明显者（B错）。乌头汤为痛痹的代表方（C错）。薏苡仁汤为着痹的代表方（D错）。